预防沙眼传播的最主要措施是
A. 积极治疗沙眼忠者
B. 对儿童保健老师进行培训
C. 加强对学生、老师和家长的相关健康教育工作
D. 定期对儿童青少年进行沙眼监测
E. 注意儿童青少年生活环境卫生

正确答案：A。积极治疗沙眼忠者